处方按性质分为
A. 法定处方
B. 麻醉药品处方
C. 协定处方
D. 医师处方
E. 精神药品处方

正确答案：A、D。法定处方；医师处方

解析：本题考查处方。处方按其性质可分为法定处方（A对）和医师处方（D对）。《处方管理办法》将处方分为麻醉药品处方（B错）、急诊处方、儿科处方、普通处方、第二类精神药品处方（E错）等。协定处方（C错）是由医药双方根据治疗需要商定并经院领导批准的本院常规处方。